治疗醛固酮升高引起顽固性水肿的药物是
A. 螺内酯
B. 甘露醇
C. 氨苯蝶啶
D. 阿米洛利
E. 呋塞米

正确答案：A。螺内酯

解析：本题考查利尿药的临床作用。治疗醛固酮升高引起顽固性水肿的药物是螺内酯（A对）。螺内酯主要用于伴有醛固酮升高的顽固性水肿，如充血性心力衰竭、肝硬化腹水及肾病综合征。甘露醇（B错）为渗透性利尿药，主要用于治疗脑水肿和青光眼等，是治疗脑水肿、降低颅内压的首选药物。氨苯蝶啶（C错）在临床上用于治疗各种水肿，常与排钾利尿药合用治疗顽固性水肿。阿米洛利（D错）临床用于治疗充血性心力衰竭、肝硬化腹水和肾病综合征等水肿性疾病以及肾上腺糖皮质激素治疗过程中发生的水钠潴留。呋塞米（E错）为常用的速效利尿剂，主要用于急性肺水肿和脑水肿、急慢性肾衰竭、加速毒物排泄等。